下列有关人体内RNA的错误叙述是
A. RNA与多种蛋白质共同构成核糖体
B. 仅存在rRNA、tRNA和mRNA这三种RNA
C. RNA存在局部双链结构
D. rRNA是含量最丰富的RNA
E. tRNA是蛋白质合成中氨基酸的载体

正确答案：B。仅存在rRNA、tRNA和mRNA这三种RNA